属于药理性拮抗的药物相互作用有
A. 肾上腺素拮抗组胺的作用，治疗过敏性休克
B. 普萘洛尔与异丙肾上腺素合用，β受体激动作用消失
C. 间羟胺对抗氯丙嗪引起的体位性低血压
D. 克林霉素与红霉素联用，可产生拮抗作用
E. 三环类抗抑郁药抑制神经末梢对去甲肾上腺素再摄取，引起高血压危象

正确答案：B、C、D。普萘洛尔与异丙肾上腺素合用，β受体激动作用消失；间羟胺对抗氯丙嗪引起的体位性低血压；克林霉素与红霉素联用，可产生拮抗作用

解析：本题考查药理性拮抗。属于药理性拮抗的药物相互作用有：普萘洛尔与异丙肾上腺素合用，β受体激动作用消失（B对）；间羟胺对抗氯丙嗪引起的体位性低血压（C对）；克林霉素与红霉素联用，可产生拮抗作用（D对）；肾上腺素作用于β肾上腺素受体，用于治疗过敏性休克（A错）属于生理性拮抗；三环类抗抑郁药抑制神经末梢对去甲肾上腺素再摄取，引起高血压危象（E错）不属于药理性拮抗。